以上辅料中，属于阴离子型表面活性剂的是
A. 十二烷基硫酸钠
B. 聚山梨酯80
C. 苯扎溴铵
D. 卵磷脂
E. 二甲基亚砜

正确答案：A。十二烷基硫酸钠

解析：本题考查表面活性剂。十二烷基硫酸钠（A对）为阴离子型表面活性剂，阴离子表面活性剂包括高级脂肪酸盐、硫酸化物、磺酸化物等。吐温80（B错）为非离子型表面活性剂。苯扎溴铵（C错）为阳离子型表面活性剂。卵磷脂（D错）为两性离子型表面活性剂。二甲基亚砜（E错）不属于表面活性剂。